感染性心内膜炎最常累及的部位是
A. 室间隔缺损处
B. 心脏瓣膜
C. 动静脉瘘
D. 房间隔缺损处
E. 动脉导管未闭

正确答案：B。心脏瓣膜

解析：感染性心内膜炎最常累及的部位是心脏瓣膜（B对），也可发生在间隔缺损部位（AD错）、腱索或心壁内膜。